下列除哪项外，均是黄芪的主治病证
A. 脾肺气虚
B. 中气下陷
C. 表虚自汗
D. 疮痈毒盛
E. 气虚水肿

正确答案：D。疮痈毒盛

解析：黄芪为补气药，归脾、肺经，能补脾肺气虚（A对）。黄芪能够补气升阳，可以治疗中气下陷证（B对）。黄芪能够固表止汗，可以用来治疗肺气虚的表虚自汗（C对）。同时，黄芪还有利水消肿的功效，因此可以用来治疗气虚水肿（E对）。黄芪虽然有托毒排脓的功效，但黄芪主要用于治疗痈疽难溃，久溃不敛，属正虚毒盛者（D错，为本题正确答案）。